25岁初孕妇，妊娠36周枕右前位，出现少量阴道流血，无宫缩，胎心136次/分。本例最恰当的处理方法应是
A. 期待疗法
B. 缩宫素静脉滴注引产
C. 立即行人工破膜
D. 立即静脉滴注止血药物
E. 行剖宫产术

正确答案：A。期待疗法

解析：青年初孕妇，妊娠36周，胎位正（枕右前），胎心136次/分（正常值110～160次/分），出现少量阴道流血，无宫缩（排除先兆流产），可先期待疗法（A对），若出现了宫缩、宫颈管消退等症状再做处理。缩宫素静脉滴注引产（P189）（B错）适用于协调性宫缩乏力、宫口扩张≥3cm、胎心良好、胎位正常、头盆相称者。人工破膜（C错）适用于协调性宫缩乏力，宫口扩张≥3cm、无头盆不称、胎头已衔接而产程延缓者。孕期阴道流血，不能轻易用止血药物控制症状，应从病因治疗，以免延误病情，因此立即静脉滴注止血药物（D错）不恰当。当出现产程无进展、胎儿窘迫、头盆不称等征象时，才需要行剖宫产术（E错）。